三叉丘系损伤将导致
A. 同侧头面部痛、温觉和触觉的丧失
B. 对侧头面部痛、温觉和触觉的丧失
C. 同侧躯干、四肢痛、温觉和触觉的丧失
D. 对侧躯干、四肢痛、温觉和触觉的丧失
E. 以上都不是

正确答案：B。对侧头面部痛、温觉和触觉的丧失

解析：三叉丘系由对侧三叉神经脊束核和双侧三叉神经脑桥核（主要为对侧）发出的二级感觉纤维组成，故传递的是对侧头面部痛、温觉和触觉，损伤后将导致对侧头面部痛、温觉和触觉的丧失（B对）。对侧躯干、四肢痛、温觉和触觉的丧失（D错）见于脊髓丘系损伤。